正常人空腹血糖水平（mmol/L）
A. 0～2.5
B. 2.6～3.8
C. 3.9～6.1
D. 6.2～8.5
E. 8.6～10.0

正确答案：C。3.9～6.1